患者，男，34岁，晨起出现上腹部剧烈疼痛，考虑为胃肠道平滑肌痉挛，适宜该患者使用的治疗药物是
A. 溴吡斯的明
B. 山莨菪碱
C. 多潘立酮
D. 酚妥拉明
E. 莫沙必利

正确答案：B。山莨菪碱

解析：本题考查山莨菪碱。适宜胃肠道平滑肌痉挛的治疗药物是山莨菪碱（B对）。山莨菪碱为胆碱M受体阻断剂，可以用于解除平滑肌痉挛；溴吡斯的明（A错）为抗胆碱酯酶药，用于重症肌无力；多潘立酮（C错）为胃肠动力药，用于消化不良、腹胀、嗳气、恶心、呕吐、腹部胀痛；酚妥拉明（D错）为α肾上腺素受体阻滞药；莫沙必利（E错）为消化道促动力剂。